非间叶组织来源的肿瘤是
A. 乳头状瘤
B. 血管瘤
C. 淋巴管瘤
D. 脂肪瘤
E. 平滑肌瘤

正确答案：A。乳头状瘤

解析：乳头状瘤（A对）是来源于上皮组织的良性肿瘤。血管瘤（B错）、淋巴管瘤（C错）、脂肪瘤（D错）和平滑肌瘤（E错）均为来源于间叶组织的良性肿瘤。